下列关于处方药与非处方药转换和评价的说法，错误的是
A. 县级以上药品监督管理部门应当及时收集、汇总对非处方药品种的意见，尤其是药品安全性的情况，向上一级药品监督管部门反馈
B. 国家药品监督管理部门开展处方药与非处为药的监测、转换和评价工作，对存在安全隐患的按非处方药管理的品种及时转换为按处方药管理
C. 非处方药的有效性包括用药对象明确，适应症或者功能主治明确、用法用量明确、疗效确切等特点
D. 从药品安全性考虑，严重不良反应发生率达万分之一以上的药品不应当作为乙类非处方药

正确答案：A。县级以上药品监督管理部门应当及时收集、汇总对非处方药品种的意见，尤其是药品安全性的情况，向上一级药品监督管部门反馈

解析：本题考查非处方药转换为处方药。非处方药转换为处方药国家药品监督管理局应当开展对已批准为非处方药品种的监测和评价工作，对存在安全隐患或不适宜按非处方药管理的品种将及时转换为处方药，按处方药管理。省级药品监督管理部门要及时收集并汇总对非处方药品种的意见，特别是药品安全性的情况，及时向国家药品监督管理局反馈（A错，为本题正确答案）。药品生产、经营、使用、监管单位认为其生产、经营、使用、管理的非处方药存在安全隐患或不适宜按非处方药管理，可填写《非处方药转换为处方药意见表》，或向所在地省级药品监督管理部门提出转换的申请或意见（B对）。非处方药的有效性应具有如下特点：一是用药对象明确，适应症或功能主治明确；二是绝大多数适用对象正确使用后能产生预期的作用；三是用法用量明确；四是不需要与其他药物联合使用（辅助治疗药品除外）；五是疗效确切，用药后的效果明显或明确，患者一般可以自我感知（C对）。不应作为乙类非处方药：严重不良反应发生率达万分之一以上（D对）。